下列哪项是月经先期肝郁化热证的主症
A. 形寒肢冷
B. 腰膝酸软
C. 经量或多或少
D. 经色淡红
E. 经后小腹隐痛

正确答案：C。经量或多或少

解析：月经先期肝郁化热证热扰冲任，经血妄行，故月经提前；肝郁疏泄失调，血海失司，故经量或多或少（C对）；热灼于血，故经色深红或紫红，质稠；气滞血瘀，则经行不畅，或有血块；气滞肝经则胸胁、乳房、少腹胀痛。形寒肢冷（A错）多出现在实寒证中。腰膝酸软（B错）多出现在肾虚证中。经色淡红（D错）多出现在血虚证中。经后小腹隐痛（E错）多出现在虚寒证中。